肝性脑病合并便秘患者首选的泻药是
A. 硫酸镁
B. 比沙可啶
C. 双歧杆菌
D. 干酵母
E. 乳果糖

正确答案：E。乳果糖

解析：本题考查泻药。肝性脑病合并便秘患者首选的泻药是乳果糖（E对）。乳果糖尤其适用于肝性脑病患者及长期卧床的老年便秘者，需长期规律应用。硫酸镁（A错）为容积性泻药，停留于肠腔内使肠内容积的渗透压升高，反射性增加肠蠕动而导泻。比沙可啶（B错）有较强刺激性，应避免吸入或与眼睛、皮肤黏膜接触，在服药时不得嚼碎。双歧杆菌（C错）属于微生态制剂，可补充人体正常生理细菌，调节肠道菌群平衡，清除有害菌。干酵母（D错）用于消化不良、食欲减退、腹泻及胃胀气。